腰丛来自哪些脊神经的前支
A. 腰1--4
B. 胸12部分,腰1--5
C. 胸12全部,腰1--3
D. 腰1--5
E. 胸12的部分,腰1--3,腰4部分

正确答案：E。胸12的部分,腰1--3,腰4部分

解析：腰丛由第12胸神经前支的一部分、第1-3腰神经前支及第4腰神经前支的一部分组成（E对）。